依据《中华人民共和国药品管理法实施办法》，医疗单位的《制剂许可证》有效期为
A. 三年
B. 四年
C. 五年
D. 六年
E. 二年

正确答案：C。五年

解析：本题考查医疗单位的《制剂许可证》有效期。依据《中华人民共和国药品管理法实施办法》，医疗单位的《制剂许可证》有效期为5年（C对）。国家药品监督管理局决定自2016年1月1日起启用新版《医疗机构制剂许可证》。新版《医疗机构制剂许可证》有效期为5年，明确了日常监管机构和日常监管人员，录入了法定代表人、制剂室负责人、质量负责人等关键人员的个人信息，增加了“社会信用代码”、举报电话等信息，并加附了防伪二维码全息图片，任何机构和个人均可扫描二维码查验证书真伪。